恶性转化细胞的特征不包括
A. 细胞形态改变
B. 细胞生长能力改变
C. 细胞生化表型改变
D. 细胞坏死

正确答案：D。细胞坏死

解析：本题考查恶性转化细胞的特征。恶性转化细胞的特征包括：细胞形态改变（A对）；细胞生长能力改变（B对）；细胞生化表型改变（C对）；与肿瘤形成有关的表型。细胞坏死（D错，为本题正确答案）不是恶性转化细胞的特征。